寻常疣和尖锐湿疣的病原是
A. CMV
B. HSV-2
C. HIV
D. HPV
E. EBV

正确答案：D。HPV

解析：人是HPV唯一的自然宿主，是人类肿瘤病毒。其感染可引起乳头状瘤，包括皮肤疣、外生殖器尖锐湿疣等。掌握“狂犬病、人乳头瘤病毒”知识点。